患儿突发寒战高热，伴头痛呕吐，全身乏力，肌肉酸痛，食欲不振，神志淡漠。查体：全身皮肤黏膜散在出血点，颈项强直，克氏征阳性。应首先考虑的是
A. 菌痢
B. 伤寒
C. 乙脑
D. 流脑
E. 脑膜炎

正确答案：D。流脑

解析：本例患者为幼儿，抵抗力较弱，出现突然寒战、高热，伴头痛、呕吐、肌肉酸痛、食欲不振、神志淡漠等败血症的表现，及全身皮肤黏膜散在出血点和颈项强直、克氏征阳性等脑膜刺激征表现，应首先考虑为流脑（D对）。菌痢（A错）常于发病24小时内出现高热、抽搐、昏迷和感染中毒性休克，一般无脑膜刺激征。伤寒（B错）亦有长期发热、皮疹和中枢神经系统症状，但头痛、全身酸痛症状较轻，皮疹出现晚且数量少，有相对缓脉、外周血白细胞减少，依据肥达反应阳性，血或骨髓培养分离出伤寒杆菌可鉴别诊断。乙脑（C错）临床以起病急、高热、头痛、呕吐、意识障碍、抽搐、病理反射及脑膜刺激征阳性等为特征，通常没有皮肤黏膜散在出血点。脑膜炎（E错）有脑膜刺激征，是各种病理因素引起的脑膜病变。